患者，男，60岁，因心绞痛给予普萘洛尔治疗。普萘洛尔的禁忌症是
A. 双侧肾动脉狭窄
B. 心力衰竭
C. 痛风
D. 冠心病
E. 哮喘

正确答案：E。哮喘

解析：本题考查药物的禁忌症。普萘洛尔的禁忌症是哮喘（E对）。普萘洛尔为β受体阻断药，禁用于严重左心室功能不全、窦性心动过缓、房室传导阻滞及支气管哮喘患者。双侧肾动脉狭窄（A错）是ACEI类药物的禁忌症。心力衰竭（B错）是非二氢吡啶类钙通道阻滞剂的禁忌症。痛风（C错）是噻嗪类利尿剂的禁忌症。